下列关于脂肪氧化分解过程的叙述，错误的是
A. β-氧化中的受氢体为NAD⁺和FAD
B. 含16个碳原子的软脂酸经过8次β氧化
C. 脂肪酰CoA需转运入线粒体
D. 脂肪酸首先要活化生成脂肪酰CoA
E. β氧化的4步反应为脱氢、加水、再脱氢和硫解

正确答案：B。含16个碳原子的软脂酸经过8次β氧化

解析：脂肪酸β-氧化分三步进行：①脂肪酸首先要活化生成脂酰CoA（D对）；②脂酰CoA需转运入线粒体（C对），此反应由肉碱脂酰转移酶Ⅰ催化；③脂酰CoA分解产生乙酰CoA、FADH₂、NADH，NAD⁺和FAD为受氢体（A对），β氧化过程分脱氢、加水、再脱氢、硫解四步进行（E对）。1分子软脂酸（16碳）彻底氧化需进行7次β-氧化（B错，为本题正确答案），生成7分子FADH₂，7分子NADH及8分子乙酰CoA。